可表现慢性腹泻的疾病是
A. 伤寒
B. 过敏性紫癜
C. 出血性肠炎
D. 尿毒症
E. 急性中毒

正确答案：D。尿毒症

解析：腹泻可分为急性腹泻和慢性腹泻。急性腹泻常见于肠道疾病如出血性肠炎（C错）等、急性中毒（E错）、全身感染如伤寒（A错）等和其他疾病如过敏性紫癜（B错）等。慢性腹泻常见于消化系统疾病和全身性疾病如尿毒症（D对）等。